公卫医师何某在取得执业医师资格证书和执业许可证后的1年里，擅自从事婚前医学检查、遗传病诊断和产前诊断，虽经卫生行政部门制止，仍不改正，并又实施终止妊娠手术，依据《母婴保健法》的规定。可以给予何种行政处罚
A. 处以罚款
B. 没收违法所得
C. 没收非法财物
D. 吊销执业许可证
E. 行政拘留

正确答案：A。处以罚款